属于神经肽-1受体阻断剂的止吐药是
A. 甲氧氯普胺
B. 维生素B₆
C. 托烷司琼
D. 阿瑞吡坦
E. 西咪替丁

正确答案：D。阿瑞吡坦

解析：本题考查止吐药的分类。止吐药按作用机制将其分为三类：1.多巴胺受体阻断剂，其代表药为甲氧氯普胺（A错）；2.5-HT₃受体阻断剂，其代表药为托烷司琼（C错）；3.神经激肽-1受体阻断剂，其代表药为阿瑞吡坦（D对）。维生素B₆（B错）是一种水溶性维生素，临床上应用维生素B₆制剂防治妊娠呕吐和放射病呕吐；西咪替丁（E错）为一种H₂受体拮抗剂，能明显地抑制食物、组胺、五肽胃泌素、咖啡因与胰岛素等刺激引起的胃酸分泌。